对映异构体之间具有相同的药理作用和强度的手性药物是
A. 氯苯那敏
B. 普罗帕酮
C. 扎考必利
D. 氯胺酮
E. 氨已烯酸

正确答案：B。普罗帕酮

解析：本题考查药物的手性结构对药物活性的影响。对映异构体之间具有相同的药理作用和强度的手性药物是普罗帕酮（B对）。手性药物的两个对映体之间的药理作用和强度以及与消旋体之间没有明显差异，产生这样结果的原因是药物的手性中心不在与受体结合的部位，属于静态手性类药物。两个对映体有相似的药理活性，但作用强度有明显的差异。例如抗过敏药氯苯那敏（A错），其右旋体的活性高于左旋体，产生的原因是由于分子中的手性碳原子离芳环近，对药物受体相互作用产生空间选择性。抗精神病药扎考必利（C错）对映异构体之间产生相反的活性。扎考必利通过作用于5-HT₃受体而起效的，其中R-对映体为5-HT₃受体阻断剂，S-对映体为5-HT₃受体激动剂。氯胺酮（D错）一种对映体具有药理活性，另一对映体具有毒性作用。氯胺酮为中枢性麻醉药物，只有R-（+）-对映体才具有麻醉作用，而S-（-）-对映体则产生中枢兴奋作用。目前S-（-）-对映体艾司氯胺酮被批准上市用于抑郁症的治疗。药物中只有一个异构体有药理活性，而另一个没有或几乎没有活性，表现出药物与生物靶点作用的立体选择性。这种情况比较多，例如抗高血压药物L-甲基多巴，仅L-构型的化合物有效。氨已烯酸（E错）只有S-对映体是GABA转氨酶抑制剂。产生这种严格的构型与活性差异的原因，部分是来自受体对药物的空间结构要求比较严格。